负责学校卫生工作行政管理的部门是
A. 卫生行政部门
B. 教育行政部门
C. 工商行政部门
D. 学校行政管理部门
E. 卫生监督部门

正确答案：B。教育行政部门